男，45岁。突发右胸痛、呼吸困难2天。CTPA示右下肺动脉分支中可见充盈缺损。该患者首选的治疗措施是
A. 迅速止痛
B. 机械通气
C. 皮下注射低分子肝素
D. 手术治疗
E. 介入治疗

正确答案：C。皮下注射低分子肝素

解析：患者为中年男性，突发胸痛、呼吸困难2天，CTPA显示右下肺动脉分支中有充盈缺损（为肺动脉栓塞症的直接征象），根据其临床表现和辅助检查，可以诊断为肺动脉栓塞症（符合肺动脉栓塞症的临床表现及辅助检查）。对于高度怀疑或确诊肺动脉栓塞的患者，如无禁忌征，应立即开始抗凝治疗（C对）。迅速止痛（A错）为肺动脉栓塞的对症治疗，为一般疗法，不是首选的治疗措施。机械通气（B错）适应症为各种急慢性呼吸衰竭。手术治疗和介入治疗（DE错）适用于有溶栓禁忌征或溶栓治疗无效者，不作为首选的治疗措施。